苏合香丸具有芳香开窍、行气止痛的功效，用于痰迷心窍所致的痰厥昏迷、中风偏瘫、肢体不利、以及中暑心胃气痛。处方组成：苏合香、安息香、水牛角浓缩粉、檀香、沉香、丁香等十五味药材。以上十五味除苏合香、人工麝香冰片、水牛角浓缩粉外朱砂水飞成极细粉；其余安息香等十味粉碎成粉；将人工麝香片、水车角浓缩粉研细与上述粉末配研混匀。再将苏合香炖化加适量炼蜜与水制成水蜜丸低温干燥；或加适量炼蜜制成大蜜丸即得。中药丸剂尤其是蜜丸与水蜜丸。若含水量过高。贮存期间极易发霉变质。苏合香丸若为水蜜丸。根据《中国药典》规定，其水分不得过
A. 0.12
B. 0.03
C. 0.06
D. 0.09
E. 0.15

正确答案：A。0.12

解析：本题考查的是丸剂的水分。苏合香丸若为水蜜丸。根据《中国药典》规定，其水分不得过12.00%（A对）。除另有规定外，蜜丸和浓缩蜜丸中所含水分不得过15.0%（E错）；水蜜丸和浓缩水蜜丸不得过12.0%；水丸、糊丸、浓缩水丸不得过9.0%（D错）。蜡丸不检查水分。含水量不超过3.00%（B错）的制剂为含糖块茶剂。按照《中国药典》规定的方法检查，不含糖块状茶剂以及袋装茶剂与煎煮茶剂的水分不得过12.0%，含糖块状茶剂的水分不得过3.0%。